镜下可见瘤细胞短梭形，细胞交错排列呈漩涡状的肿瘤是
A. 库肯勃瘤
B. 卵泡膜细胞瘤
C. 纤维瘤
D. 颗粒细胞瘤
E. 畸胎瘤

正确答案：B。卵泡膜细胞瘤

解析：镜下可见瘤细胞短梭形，细胞交错排列呈漩涡状的肿瘤是卵泡膜细胞瘤（B对），常与颗粒细胞瘤同时存在，但也可单一成分，多为良性。良性多为单侧，圆形、卵圆形或分叶状，表面被覆薄的有光泽的纤维包膜。切面为实性、灰白色。